某历史人物曾遇到一个场景是：前有大河，后又追兵，此时该人物面临的动机冲突类型是
A. 双趋冲突
B. 趋避冲突
C. 双避冲突
D. 双重趋避
E. 双重避趋

正确答案：C。双避冲突

解析：本题考查动机冲突。某历史人物曾遇到一个场景是：前有大河，后又追兵，此时该人物面临的动机冲突类型是双避冲突（C对）。双趋冲突（A错）也称接近-接近式冲突，两个目标具有相同的吸引力，引起同样强度的动机；但由于受条件等因素的限制，无法同时实现，二者必择其一，即所谓“鱼和熊掌不可兼得”。趋避冲突（B错）也称接近-避式冲突，指—个人对同—事物同时产生两种动机，即向往得到它，同时乂想拒绝和避开它。双重趋避（D错）与双重避趋（E错）亦称双重接近-避式冲突，人们常常会遇到多个目标，每个目标对自己都有利也都荷弊，反复权衡拿不定主意所产生的冲突。